咀嚼黏膜包括
A. 硬腭和牙龈
B. 颊黏膜
C. 口底黏膜
D. 舌黏膜
E. 软腭黏膜

正确答案：A。硬腭和牙龈

解析：咀嚼黏膜包括硬腭和牙龈黏膜，承受咀嚼压力，特点是上皮较厚，上皮表层有正角化或不全角化，有粒层，细胞间隙宽并见细胞间桥；固有层厚，胶原纤维粗大，排列紧密呈网状，固有层的乳头多而长，与上皮钉突呈指状镶嵌，形成良好的机械附着，可有效地防止上皮在外力作用下与下面的结缔组织分开。咀嚼黏膜或借固有层直接附在骨膜上，形成黏骨膜或借黏膜下层与骨膜相连。掌握“口腔黏膜基本结构”知识点。